具有行气止痛，解毒消肿作用的药物是
A. 乌药
B. 沉香
C. 川楝子
D. 青木香
E. 薤白

正确答案：D。青木香

解析：青木香性味辛、苦、寒，小毒；归肝、胃经。具有行气止痛，解毒消肿的功效。适用于肝胃气滞之胸胁脘腹疼痛，泻痢腹痛，疔疮肿毒，皮肤湿疮，毒蛇咬伤（D对）。乌药的功效为行气止痛，温肾散寒（A错）。沉香的功效为行气止痛，温肾散寒（B错）。川楝子的功效为疏肝泄热，行气止痛，杀虫疗癣（C对）。薤白的功效为通阳散结，行气导滞（E错）。